多环芳烃的主要来源包括（）等
A. 燃料燃烧
B. 有机物土壤微生物分解
C. 甲壳类动物体内蓄积
D. 食品的熏制和烘烤

正确答案：A。燃料燃烧

解析：本题考查多环芳烃的主要来源。多环芳烃的主要来源是燃料燃烧（A对BCD错）。